患者凭医疗机构开具的处方到甲药品零售企业调剂处方药H，同时购买处方药I、甲类非处方药J和乙类非处方药K，甲药品零售企业为患者提供药品H、I、J、K的同时，又赠送患者近效期的非处方药L。该患者购实药品之后，欲寻求执业药师指导用药，被告知执业药师不在岗。甲药品零售企业违反药品购销管理规定的行为，不包括
A. 执业药师不在岗时，调剂药品H
B. 执业药师不在岗时，销售药品I、J
C. 执业药师不在岗时，未挂牌告知
D. 执业药师不在岗时，销售药品K

正确答案：D。执业药师不在岗时，销售药品K

解析：本题考查执业药师的职责。患者凭医疗机构开具的处方到甲药品零售企业调剂处方药H，同时购买处方药I、甲类非处方药J和乙类非处方药K，甲药品零售企业为患者提供药品H、I、J、K的同时，又赠送患者近效期的非处方药L。该患者购实药品之后，欲寻求执业药师指导用药，被告知执业药师不在岗。甲药品零售企业违反药品购销管理规定的行为，不包括执业药师不在岗时，销售药品K（D错，为本题正确答案）。《国家药监局人力资源社会保障部关于印发执业药师职业资格制度规定和执业药师职业资格考试实施办法的通知》第四章职责第二十一条：药品零售企业应当在醒目位置公示《执业药师注册证》，并对在岗执业的执业药师挂牌明示。执业药师不在岗时，应当以醒目方式公示（C对），并停止销售处方药和甲类非处方药（AB对）。执业药师执业时应当按照有关规定佩戴工作牌。